男性，21岁。呼吸困难，咳嗽，汗出1小时而就诊。查体：端坐呼吸，呼吸急促，口唇微绀，心率114次/分，律不齐，双肺满布哮鸣音。为迅速缓解症状，应立即采取的最佳治法是
A. 口服氨茶碱
B. 肌注氨茶碱
C. 喷吸沙丁胺醇
D. 口服泼尼松
E. 口服阿托品

正确答案：C。喷吸沙丁胺醇

解析：支气管舒张剂包括β₂受体激动剂，茶碱类，抗胆碱药物；β₂受体激动剂沙丁胺醇是缓解轻中急性哮喘症状的首选药物（C对）。茶碱类是我国第一线夜间发作首选药。本品与β₂受体激动剂联合应用时易诱发心律失常，应慎用，并适当减少剂量。与糖皮质激素合用具有协同作用（AB错）。口服剂：泼尼松、泼尼松龙，用于吸入糖皮质激素无效或需要短期加强的患者（D错）。阿托品对舒张支气管平滑肌的作用较弱（E错）。